现代临床药物治疗更多依赖于循证医学的支持，在循证医学据分级中，证据和推荐强度级别最高的是
A. 大样本病案系列
B. 单个大样本随机对照试验
C. 同质随机对照试验的系统评价
D. 同质病例对照试验研究的系统评价
E. 专家意见

正确答案：C。同质随机对照试验的系统评价

解析：本题考查循证医学的证据分级。在循证医学据分级中，证据和推荐强度级别最高的是同质随机对照试验的系统评价（D对）。当前应用较多的则为2001年5月英国Cochrane中心制定的证据水平评价标准，其根据研究类型将证据分为5级：Ⅰ级，设计良好的随机对照试验；Ⅱ级，设计较好的队列或者病例对照研究；Ⅲ级，病历报告或者有缺点的临床试验；Ⅳ级，病例分析或者质量差的病例对照研究；V级，专家意见或者基于生理、病理生理和基础研究的证据。